下列临床表现中，最不常见于慢性粒细胞白血病的是
A. 乏力低热
B. 体重减轻
C. 胸骨中下段压痛
D. 淋巴结肿大
E. 巨脾

正确答案：D。淋巴结肿大

解析：慢性粒细胞白血病常见的临床表现有乏力、低热（A对）、多汗或盗汗、体重减轻（B对），常见巨脾，部分患者出现胸骨中下段压痛等症状。淋巴结肿大（D错，为本题正确答案）常见于急、慢性淋巴细胞性白血病、淋巴瘤等，而慢性粒细胞白血病少见。